目前唾液腺造影术可用于
A. 舌下腺及下颌下腺
B. 舌下腺及腮腺
C. 舌下腺
D. 腮腺及腭腺
E. 腮腺及下颌下腺

正确答案：E。腮腺及下颌下腺

解析：目前唾液腺造影术只限于腮腺及下颌下腺。掌握“唾液腺造影技术、CT及MRI”知识点。